属于儿童禁用情况有
A. 地西泮用于6个月以下的幼儿
B. 阿司匹林用于2～14岁儿童
C. 尼美舒利用于14岁以下的儿童
D. 布洛芬用于14岁以下儿童
E. 吗啡用于1岁以下幼儿

正确答案：A、E。地西泮用于6个月以下的幼儿；吗啡用于1岁以下幼儿

解析：本题考查儿童用药。地西泮禁用于对地西泮过敏者、妊娠期妇女、新生儿，新生儿是指出生到生后满28天的婴儿，6个月以下的幼儿包括新生儿（A对）；吗啡禁用于妊娠期妇女、哺乳期妇女、新生儿和婴儿（E对）；阿司匹林可用于2-14岁儿童（B错），但须慎用；尼美舒利口服制剂禁止用于12岁以下儿童（C错）；布洛芬可用于12岁以下儿童（D错）。